应用全胃肠外营养时，氮和热量之比应为
A. 1：50～80Kcal
B. 1：100～120Kcal
C. 1：150～200Kal
D. 1：210～240Kcal
E. 1：250Kcal以上

正确答案：C。1：150～200Kal

解析：含有1g氮的蛋白质（即6.25g蛋白质）进入组织原浆需要150kal非蛋白质能源，为保证输入的氮能被用以合成蛋白质，每输入1g氮，需要同时提供628kJ（150kal）的热量，成为现时标准营养混合制剂中的热氮比，即1：150～200Kal（C对）。